具有排钾作用的利尿药是
A. 甘露醇
B. 去氨加压素
C. 螺内酯
D. 甘油果糖
E. 氢氯噻嗪

正确答案：E。氢氯噻嗪

解析：本题考查氢氯噻嗪的作用。具有排钾作用的利尿药是氢氯噻嗪（E对）。氢氯噻嗪的作用机制是抑制远曲小管近端Na⁺-Cl⁻共转运体，抑制NaCl的重吸收。由于转运至远曲小管Na⁺增加，促进了K⁺-Na⁺交换。尿中除排出Na⁺、Cl⁻外，K⁺的排泄也增多，长期服用可引起低血钾。甘露醇（A错）为渗透性利尿剂，静注甘露醇后，血浆渗透压升高，血容量增加，血液黏滞度降低；并通过稀释血液而增加循环血容量及肾小球滤过率；甘露醇从肾小球滤过时，在肾小管中不易被重吸收，使水在近曲小管和髓袢升支的重吸收减少而起到利尿的作用。去氨加压素（B错）是人工合成的加压素的类似物，它的主要作用是抗利尿，抗利尿作用可达24小时。在临床上常用于治疗神经垂体功能不足引起的中枢性尿崩症。螺内酯（C错）属于醛固酮受体拮抗剂，表现为排钠保钾作用。甘油果糖（D错）为渗透性利尿药，由于高渗，静脉注射后能提高血浆渗透压，导致组织内（包括眼、脑、脑脊液等）的水分进入血管内，从而减轻组织水肿，降低颅内压、眼压和脑脊液容量及其压力。